某一社区居民的龋病患病率高，拟对他们进行龋活性试验，检测变形链球菌数量的方法是
A. Snyder试验
B. Dentocult-LB试验
C. Cariostat试验
D. 刃天青纸片法
E. DeutobuffStrip试验

正确答案：D。刃天青纸片法

解析：刃天青纸片法：用颜色显色法观察唾液内变形链球菌的数量。掌握“龋病预测与早期诊断”知识点。